股骨下端与何骨相关节
A. 髌骨和胫骨上端
B. 髌骨和腓骨
C. 腓骨和胫骨上端
D. 胫骨粗隆和髌骨
E. 以上都不是

正确答案：A。髌骨和胫骨上端

解析：股骨下端和胫骨上端以及髌骨相关节（A对）构成了膝关节。